正常覆盖时，上切牙切缘到下切牙切缘的距离是
A. 0mm
B. 2～4mm
C. 3～5mm
D. 5～7mm
E. 7mm以上

正确答案：B。2～4mm

解析：本题考查覆盖。覆盖正常约为2～4mm（B对）。上切缘到下切缘唇面的水平距离在3mm以上者为深覆盖，Ⅰ度深覆盖：3mm＜覆盖≤5mm（C错）；Ⅱ度深覆盖：5＜覆盖≤7mm（D错）；Ⅲ度深覆盖：覆盖＞7mm（E错）。覆（牙合）：指上颌牙盖过下颌牙唇、颊面的垂直距离。